不全流产的特征是
A. 易休克和感染
B. 腹痛
C. 阴道流血
D. 无妊娠物排出
E. 妊娠物完全排出

正确答案：A。易休克和感染

解析：不全流产时，部分妊娠物排出宫腔（DE错），还有部分残留于宫腔内或嵌顿于宫颈口处，或胎儿排出后胎盘滞留宫腔或嵌顿于宫颈口，影响子宫收缩，导致大量出血，且流血时间长，容易并发休克和感染（A对）。腹痛（B错）和阴道流血（C错）是流产的一般性特征，无特异性。